男，7个月。不活泼，食欲差，面色苍白。血红蛋白80g/L，红细胞数3×10¹²/L，考虑为
A. 营养不良Ⅰ度
B. 营养不良Ⅱ度
C. 营养不良Ⅲ度
D. 营养性缺铁性贫血
E. 营养性巨幼红细胞性贫血

正确答案：D。营养性缺铁性贫血

解析：该患儿血红蛋白80g/L可知为中度贫血，并且有不活泼、食欲差、面色苍白的临床表现，应诊断为营养性缺铁性贫血（D对）。营养性巨幼红细胞贫血的面色为苍黄而该患儿面色为苍白（E错）。营养不良最特征的表现是体重不增，与该患儿的表现不符，不能诊断为营养不良（ABC错）。